采用病例对照研究方法进行母亲吸烟与出生缺陷关系的调查，其最大优越性在于该研究方法适用于
A. 罕见疾病的研究
B. 罕见暴露的研究
C. 常见疾病的研究
D. 因果关联的确证性研究
E. 病因的广泛探索

正确答案：A。罕见疾病的研究

解析：本题考查病例对照研究的用途。病例对照研究最常被用于疾病病因或危险因素的研究，特别适合于研究某些潜伏期长以及罕见的疾病（A对BCE错）。因果关联的确证性研究（D错）属于实验流行病学的用途。